关于游离皮片移植的叙述，哪项是错误的
A. 按皮肤厚度分为表层皮片、中厚皮片及全厚皮片
B. 皮片愈薄生活力愈强，移植后收缩愈大
C. 中厚皮片包括表皮及真皮全层
D. 面颈部植皮多采用全厚或厚中厚皮片
E. 有感染的肉芽创面只能采用表层皮片移植

正确答案：C。中厚皮片包括表皮及真皮全层

解析：中厚皮片包括表皮及一部分真皮层。全厚皮包括表皮及真皮的全层。掌握“皮片移植”知识点。